激情是一种
A. 快乐时的情绪状态
B. 短暂爆发的情绪状态
C. 积极的情绪状态
D. 持久的情绪状态
E. 快乐的状态

正确答案：B。短暂爆发的情绪状态

解析：本题考查激情。激情是一种短暂爆发的情绪状态（B对），人们在生活中的狂喜、狂怒、深重的悲痛和异常的恐惧等（AE错）都是激情的表现。和心境相比，激情在强度上更大，但维持的时间一般较短暂（D错）。激情通过激烈的言语暴发出来，是一种心理能量的宣泄，从一个较长的时段来看，对人的身心健康的平衡有益，但过激的情绪也会使当时的失衡产生可能的危险（C错）。